下列关于“追赶性生长”的说法，错误的是
A. “追赶性生长”之前一定有阻碍生长的因素存在
B. 所有疾病恢复过程必然伴随儿童“追赶性生长”
C. “生长关键期”生长发育被干扰，可出现永久性的缺陷和功能障碍
D. 及时治疗疾病，有助于儿童出现“追赶性生长”
E. “追赶性生长”是儿童在生长过程中出现偏离正常生长轨迹的现象

正确答案：B。所有疾病恢复过程必然伴随儿童“追赶性生长”